患者，男，25岁，外伤前牙缺失，前来就诊，要求修复，检查时发现患者外伤后开口受限，正常人的开口度最小不能低于
A. 4.5
B. 4
C. 3.8
D. 3.7
E. 3.5

正确答案：D。3.7

解析：正常人的开口度为3.7～4.5cm，低于该值表明有开口受限。掌握“修复学临床检查”知识点。